特异性感染指
A. 金黄色葡萄球菌感染
B. 变形杆菌感染
C. 破伤风杆菌感染
D. 绿脓杆菌感染
E. 不动杆菌感染

正确答案：C。破伤风杆菌感染

解析：本题考查特殊性感染。破伤风杆菌感染（C对）是常和创伤相关联的一种特异性感染。